某女，35岁。头身困重，脘腹胀满，食纳减少，便溏稀薄，带下色白；舌淡红苔白腻，脉迟缓。辨析其证候是
A. 寒湿困脾
B. 脾气虚
C. 脾虚下陷
D. 脾阳虚
E. 脾胃湿热

正确答案：A。寒湿困脾

解析：本题考查的是寒湿困脾证的临床表现及辨证要点。某女，35岁。头身困重，脘腹胀满，食纳减少，便溏稀薄，带下色白；舌淡红苔白腻，脉迟缓。辨析其证候是寒湿困脾（A对）。寒湿困脾证的临床表现，常见脘腹胀满，头身困重，食纳减少，泛恶欲吐，口不渴，便溏稀薄，小便不利，妇女带下，舌苔白腻或厚，脉迟缓而濡。一般以脾的运化功能障碍为基础，同时又有寒湿中遏的表现为辨证要点。脾气虚（B错）证的临床表现及辨证要点由于素体虚弱，劳倦与饮食不节等，内伤脾气，以致脾气虚弱。临床上常见脾虚证候可分三类。（1）脾失健运证。（2）脾虚下陷（C错）证：临床表现常见子宫脱垂，脱肛，胃下垂，慢性腹泻，并见食纳减少，食后作胀，少腹下坠，体倦少气，气短懒言，面色萎黄，舌淡苔白，脉虚。一般以脾气虚和内脏下垂为辨证要点。（3）脾不统血证。脾阳虚（D错）证的临床表现，常见在脾失健运症状的基础上，同时出现腹中冷痛，腹满时减，得温则舒，口泛清水，四肢不温，气怯形寒，脉沉迟而舌淡苔白。妇女则见白带清稀，小腹下坠，腰酸沉等症。一般以脾运失健的基础上伴有寒象为辨证要点。脾胃湿热（E错）证的临床表现，常见面目皮肤发黄，鲜明如橘色，脘腹胀满，不思饮食，厌恶油腻，恶心呕吐，体倦身重，发热，口苦，尿少而黄，舌苔黄腻，脉濡数。一般以脾的运化功能障碍和湿热内阻的症状为辨证要点。